以下关于全冠粘固后出现自发痛的可能原因的说法，哪项是错误的
A. 牙髓炎
B. 金属微电流刺激
C. 根尖周炎
D. 牙周炎
E. 以上都不是

正确答案：E。以上都不是

解析：本题考查修复后可能出现的问题-疼痛。修复体粘固后出现自发性疼痛，其常见的主要原因为牙髓炎、根尖周炎或牙周炎。粘固后出现的自发性疼痛，多是由于牙体组织切割过多，黏固前未戴暂时冠，未做牙髓安抚治疗，牙髓受刺激由牙髓充血发展为牙髓炎（A对）。金属微电流刺激（B对）牙髓组织，会引起自发性疼痛。修复体用一段时间后出现的自发性疼痛，多见于继发龋引起的牙髓炎；或由于修复前根管治疗不完善，根尖周炎（C对）未完全控制；或根管壁钻穿未完全消失炎症；或咬合创伤引起的牙周炎（D对）。故以上都不是（E错，为本题的正确答案）的说法是错误的。